分布至声门裂以下喉粘膜的感觉神经是
A. 舌咽神经舌支
B. 喉返神经
C. 舌神经
D. 副神经
E. 无

正确答案：B。喉返神经

解析：喉返神经（B对）分布于声门裂以下喉黏膜及除环甲肌外的所有喉肌，为喉肌的主要运动神经。舌咽舌肌舌支（A错）分布于舌后1/3的黏膜和味蕾。舌神经（C错）分布于口腔底和舌前2/3的黏膜。副神经（D错）支配胸锁乳突肌和斜方肌的运动。